归脾汤除益气补血外，还具有的功用是
A. 健脾养心
B. 健脾养胃
C. 健脾温胃
D. 健脾益阴
E. 健脾温阳

正确答案：A。健脾养心

解析：归脾汤中黄芪甘温，补脾益气；龙眼肉甘平，既补脾气，又养心血，二者共为君药。人参、白术皆为补脾益气之要药，与黄芪相伍，其补脾益气之功益著；当归补血养心，酸枣仁宁心安神，二药与龙眼肉相伍，补心血，安神志之力更强，均为臣药。佐以茯神养心安神、远志宁神益智；更佐理气醒脾之木香，与诸补气养血药相伍，可使其补而不滞。炙甘草补益心脾之气，并调和诸药，用为佐使。引用生姜、大枣，调和脾胃，以资化源。诸药配伍，心脾得补，气血得养，诸病自除。（A对）。四君子汤的功用为补气健脾（B错），主治脾胃气虚证。实脾散的功效有健脾温阳（E错）。